某男，24岁，有不洁性接触史，因近2日尿急、尿频、排尿刺痛而来院就诊。查体尿道口有白色脓性分泌物。分泌物涂片染色，镜下见到G-成双排列的球菌，试问，该患感染可能是由下述哪种细菌引起
A. 肺炎链球菌
B. 淋病奈瑟菌
C. 葡萄球菌
D. 链球菌
E. 脑膜炎奈瑟菌

正确答案：B。淋病奈瑟菌

解析：淋病奈瑟球菌（淋球菌）是引起人类泌尿生殖系统黏膜化脓性疾病（淋病）的病原菌，也是我国目前流行的发病率最高的性传播疾病。而其他细菌的传播途径均不是性传播。掌握“肠球菌属及奈瑟菌属”知识点。